对吸烟者提供尼古丁替代品适用于
A. 戒烟后再度吸烟者
B. 对戒烟犹豫不决者
C. 无戒烟愿望者
D. 戒断吸烟者
E. 准备戒烟者

正确答案：E。准备戒烟者